关于反佐药内涵描述正确的是
A. 防止病势拒药
B. 协调诸药之用
C. 降低君臣药之毒性
D. 减缓君臣药之烈性
E. 引方中诸药以达病所

正确答案：A。防止病势拒药

解析：佐药包括佐助药、佐制药和反佐药三种。反佐药，即根据某些病证之需，配伍少量与君药性味或作用相反而又能在治疗中起相成作用的药物，以防止药病格拒（A对），一般用量较轻；制约君、臣药的峻烈之性，或减轻或消除君、臣药毒性的药物是佐制药的作用（CD错）；协调诸药，引方中诸药以达病所是使药的作用（BE错）。